进行缓（控）释制剂的释放曲线拟合时，Higuchi释药方程为
A. ln（1-Mt/M∞）=-Kt
B. Mt/M∞=Kt1/2
C. Mt/M∞=Kt
D. Mt/M∞=K1tnK2tn
E. Mt/M∞=Kt0.45

正确答案：B。Mt/M∞=Kt1/2

解析：本题考查口服缓控释制剂的体外释放度测定。药物释放曲线的拟合：①Higuchi释药方程：Mt/M∞=Kt1/4（B对）；②一级方程:ln（1-Mt/M∞）=-Kt（A错）；③零级方程：Mt/M∞=Kt（C错）。